根管机械预备的目的如下，除外
A. 清除主根管内感染
B. 清除根管壁的感染
C. 扩大根尖孔以利引流
D. 减少弯曲根管的弯曲度
E. 预备根管形态以利充填

正确答案：C。扩大根尖孔以利引流

解析：本题考查根管机械预备的目的。根管机械预备的目的，除外扩大根尖孔以利引流（C错，为本题的正确答案）。根管机械预备是指采用根管切削器械对牙体组织进行切削、成形根管，以去除根管内感染物质，将根管预备成有利于冲洗、封药和充填的形态。根管机械预备的目的：①清理：即去除主根管（A对）和根管壁的感染（B对）；②成形：即减少弯曲根管的弯曲度（D对）、降低弯曲根管根管偏移的发生、预备根管形态以利充填（E对）等。